夏季方药养生要以甘平，甘凉之品，辅以芳化运脾之药，以防
A. 寒凉过度
B. 耗气伤津
C. 滋腻困脾
D. 大过伤阴
E. 阻遏气机

正确答案：C。滋腻困脾

解析：夏季阳气升腾，万物生长最为繁茂，选择方药则应以甘平、甘凉之品为主，不宜过用燥热温补之药，以防止燥热助火伤津；长夏湿热交蒸，长夏在五行中与土相应，与中医五脏中的脾相应，而脾性喜燥恶湿，所以长夏多患湿困脾胃之病，出现食欲不振、腹痛、腹泻等症状。此时的方药养生应以清补之品为佳，辅以芳香化湿、助脾运脾之药，以防止滋腻困脾（C对ABDE错）。